儿童缺铁性贫血的临床表现不包括
A. 面色苍白
B. 肝脾肿大
C. 肢体震颤
D. 食欲不振
E. 心率、呼吸加快

正确答案：C。肢体震颤

解析：缺铁性贫血的症状可分为缺铁原发病表现（如，黑便血便、长期月经过多等）、贫血表现、组织缺铁表现。贫血表现可理解为血流动力学改变及供氧供血不足所引起，如头晕乏力、面色苍白（A对）、心率呼吸加快（E对）等；组织缺铁表现可理解为铁相关酶功能障碍所引起，如消化腺萎缩等引起的食欲不振（D对）、舌乳头萎缩、智力减退等。肝脾肿大（B对）为儿童缺铁性贫血相对特异表现，系代偿性髓外造血引起（成年人髓外造血功能丧失）。需要注意的是，儿科学上并没有上述症状分类，统称为“临床表现”，而内科学考题常常需要大家分清每一个症状的类别，但上述分类有助于理解和记忆。肢体震颤（C错，为本题正确答案）可见于重症巨幼细胞性贫血，表现为不规则性震颤、手足无意识运动等。